描述一组正态分布资料最佳指标是
A. 四分位数间距
B. 标准差
C. 极差
D. 离均差平方和
E. 百分位数

正确答案：B。标准差

解析：随机变量X服从正态分布，μ为X的总体均数，δ²为X的总体方差，δ为标准差，μ决定着正态曲线在X轴上的位置，δ决定着正态曲线的分布形状（B对）。